戊型肝炎的潜伏期是
A. 2周～6个月
B. 4～20周
C. 2～9周
D. 2～6周
E. 1～6月

正确答案：C。2～9周

解析：各种病毒性肝炎潜伏期不同，2～6周是甲型肝炎的潜伏期时间（D错）；1～6月是乙型肝炎的潜伏期时间（E错）；2周～6个月丙型肝炎的潜伏期时间（A错）；4～20周是丁型肝炎的潜伏期时间（B错）；戊型肝炎的潜伏期时间是2～9周，平均6周（C对）。